男性，65岁，因胸痛10小时来院急诊，心电图证实为急性前壁心梗，下列哪项检查特异性最高
A. cTn峰值超过正常对照值的99个百分位
B. 血清CK-MB增高
C. 血沉加快
D. 血清CK增高
E. 血清LDH增高

正确答案：A。cTn峰值超过正常对照值的99个百分位

解析：心脏肌钙蛋白（cTn）T及I较传统的CK和CK-MB更为敏感、更可靠。在心梗症状发生后24小时内，cTn的峰值超过正常对照值的99个百分位需考虑心肌梗死的诊断。掌握“冠状动脉粥样硬化性心脏病”知识点。